经氯化消毒的饮水，其原水的有机前体物通常是指水中
A. 所含有机物
B. 能与氯形成氯化副产物的有机物
C. 能与氯形成氯化副产物的有机物和无机物
D. 能与氯形成氯化副产物的化合物
E. 含氮、磷的有机化合物

正确答案：B。能与氯形成氯化副产物的有机物

解析：本题考查有机前体物。经氯化消毒的饮水，其原水的有机前体物通常是指水中能与氯形成氯化消毒副产物的有机物（B对ACDE错），如腐殖酸、富里酸、藻类及其代谢物、蛋白质等。